男性，25岁，1年来牙龈逐渐肿大。检查发现：全口牙龈乳头及龈缘肿，上下前牙明显。龈乳头球状突起，前牙龈呈分叶状、质地坚硬，略有弹性，呈粉红色，不出血，无疼痛，龈沟加深，有菌斑，无分泌，11、21部分冠折断，已做根管治疗。在治疗中，首先采取的措施是
A. 换用其他长期服用的药物
B. 手术切除
C. 全身应用抗生素
D. 局部加强用药
E. 观察病情后，再作处理

正确答案：A。换用其他长期服用的药物

解析：多数患者可达到牙龈肥大消失的效果，如果经过上述牙周治疗后龈肥大状况改善不明显或很快复发，可与相关的专科医师协商，考虑更换药物，或与其他药物交替使用，以减轻副作用。掌握“药物性牙龈肥大”知识点。